男，40岁。1小时前游泳时溺水送来急诊。查体：P120次/分，R34次/分，BP90/60mmHg，神志尚清，烦躁不安，口唇发绀，双肺可闻及广泛湿性啰音，动脉血气分析（FiO₂=50%）；pH7.52，PaCO₂30mmHg，PaO₂60mmHg。为改善其呼吸衰竭，应首选的措施是
A. 静脉滴注呼吸兴奋剂
B. 纯氧面罩吸
C. 无创通气
D. 快速利尿
E. 静脉滴注糖皮质激素

正确答案：C。无创通气

解析：患者中年男性，溺水送来急诊。查体：P120次/分（正常值60～100次/分），R34次/分（正常12～20次/分），BP90/60mmHg（正常值90～120/60～90mmHg），神志尚清，烦躁不安，口唇发绀（缺氧表现），双肺可闻及广泛湿性啰音，动脉血气分析（FiO₂=50%）；pH7.52，PaCO₂30mmHg（正常值35～45mmHg），PaO₂60mmHg（正常值＞95mmHg）。综合患者症状及血气分析，考虑为溺水后肺动脉内的静脉血未经氧合直接流入肺静脉，导致PaO₂降低，所形成的Ⅰ型呼吸衰竭，其主要原因为肺内分流增加。为改善其呼吸衰竭，应首选的措施是无创通气（C对）。静脉滴注呼吸兴奋剂（A错）适用于呼吸中枢损伤的呼吸衰竭。纯氧面罩吸（B错）适用于除动静脉分流外的Ⅰ型呼吸衰竭，较高浓度氧气可以迅速缓解低氧血症。快速利尿（D错）对呼吸衰竭患者无明显作用。静脉滴注糖皮质激素（E错）具有抗炎、免疫、抗休克的作用，患者目前神志尚清。